结核性淋巴结炎
A. 脓肿破溃后可形成经久不愈的窦或瘘
B. 炎症波及周围组织时，可导致表面皮肤的红肿热痛
C. 多见于体弱的老年人
D. 轻者也伴有严重的全身症状
E. 以上均正确

正确答案：A。脓肿破溃后可形成经久不愈的窦或瘘

解析：结核性淋巴结炎常见于儿童及青年。轻者仅有淋巴结肿大而无全身症状。炎症波及周围组织时，淋巴结可彼此粘连成团，或与皮肤粘连。皮肤表面无红、热及明显压痛，扪之有波动感。脓肿破溃后可形成经久不愈的窦或瘘。掌握“面颈部淋巴结炎”知识点。